治疗乳牙的目的
A. 尽可能保持牙齿的功能，避免过早拔牙
B. 尽可能维持牙髓生活
C. 尽可能促进根尖的形成
D. 尽可能防止乳牙过早自行脱落替换
E. 以上均是

正确答案：E。以上均是

解析：本题考查治疗乳牙的目的。乳牙不仅是婴儿期、幼儿期和学龄期儿童咀嚼器官的主要组成部分，而且对儿童的生长发育、正常恒牙列的形成起着重要作用，对于乳牙列的疾患的采取积极的治疗，目的是保持其功能，避免过早拔牙（A对）、维持牙髓生活（B对）、促进根尖的形成（C对）以及防止乳牙过早自行脱落替换（D对），（ABCD对，故选E）。